眶底骨折应及时手术治疗，手术时机为
A. 伤后3天左右
B. 伤后1周左右
C. 伤后2周左右
D. 伤后3周左右
E. 伤后1月左右

正确答案：B。伤后1周左右

解析：眶底骨折应及时手术治疗。手术时机以伤后1周左右为宜，过早手术伤区组织肿胀未消，过晚手术伤区可能错位愈合或形成瘢痕，难以达到满意效果。掌握“颧骨及颧弓、眼眶骨折及骨折愈合过程”知识点。